不作为避孕药使用的孕激素类药物是
A. 左炔诺孕酮
B. 地屈孕酮
C. 去氧孕烯
D. 孕二烯酮
E. 羟孕酮

正确答案：D。孕二烯酮